为便于追查输血不良反应的原因，血液发出后，受血者和供血者的血样保存于2～6℃冰箱的时间至少
A. 3天
B. 4天
C. 5天
D. 6天
E. 7天

正确答案：E。7天

解析：血液发出后，受血者和供血者的血样保存于2～6℃冰箱，至少7天（E对），以便对输血不良反应追查原因。血液发出后不得退回。